以下哪项能够使初级卫生保健场所帮助家庭改变不良行为最常用的方式
A. 健康教育
B. 健康检查
C. 健康促进
D. 体格检查
E. 健康咨询

正确答案：E。健康咨询

解析：健康咨询是临床场所尤其是初级卫生保健场所帮助个体及家庭改变不良行为最常用的一种健康教育方式。掌握“干预基本模式及烟草行为干预”知识点。